患者上前牙因中龋一次复合树脂充填后，一直有冷热痛，几个月后疼痛加重，不敢咬合。查：左上1近中面充填体完好无继发龋，叩诊（++）冷热测迟钝，热测疼痛。造成该患牙的原因可能为
A. 充填材料的化学性刺激
B. 制备过程中产热过多
C. 消毒药物的刺激
D. 充填体有早接触
E. 充填材料的微渗漏

正确答案：A。充填材料的化学性刺激

解析：本题考查充填后疼痛。患者上前牙因中龋一次复合树脂充填后，一直有冷热痛，几个月后疼痛加重，不敢咬合。查：左上1近中面充填体完好无继发龋，叩诊（++）冷热测迟钝，热测疼痛。造成该患牙的原因可能为充填材料的化学性刺激（A对）。根据病例描述，中龋一次复合树脂充填后，一直有冷热痛，可见牙髓有激惹症状；几个月后疼痛加重，不敢咬合，检查见充填体完好无继发龋，叩诊（++）冷热测迟钝，热测疼痛，可考虑患牙牙髓有慢性炎症。患牙行充填治疗时未垫底，直接复合树脂充填后一直有疼痛，且呈加重的状况，则可考虑是由充填材料的化学性刺激引起的牙髓慢性炎症。制备过程中产热过多和消毒药物的刺激一般导致的牙髓激惹症状较轻，多可自行缓解（BC错）。充填体有早接触主要表现为充填后出现咀嚼性疼痛，与温度刺激无关（D错）。充填材料的微渗漏可导致继发龋的发生（E错）。